以下哪项不属于真性肿瘤
A. 牙源性黏液瘤
B. 成釉细胞瘤
C. 牙源性腺样瘤
D. 成釉细胞纤维瘤
E. 牙瘤

正确答案：E。牙瘤

解析：牙瘤是成牙组织的错构瘤或发育畸形，不是真性肿瘤。掌握“牙瘤”知识点。